胸膜为被覆于胸腔内面和肺表面的浆膜，可分脏、壁两层，脏、壁两层胸膜在肺根部互相延续，围成两个完全封闭的胸膜腔，每侧胸膜壁层互相移行之处，留有一潜在性的间隙，称胸膜隐窝。胸膜下界左侧起点是
A. 第6胸肋关节
B. 第6肋软骨
C. 第7胸肋关节处
D. 第7肋软骨
E. 第8肋

正确答案：B。第6肋软骨

解析：胸膜下界左侧起点是第6肋软骨（B对）。